细菌侵入髓腔感染牙髓的途径有两种，除了从冠部进入髓腔，另一种是
A. 从口腔黏膜入侵
B. 从牙龈入侵
C. 从牙周膜入侵
D. 从牙槽骨入侵
E. 从侧副根管入侵

正确答案：E。从侧副根管入侵

解析：细菌侵入髓腔感染牙髓的途径有两种：多数从冠方进入，也可经由根尖孔、牙根的侧副根管逆向进入髓腔。掌握“牙髓疾病的病因及分类”知识点。